含有扑热息痛和（或）扑尔敏化学药物的中成药有
A. 维C银翘片
B. 贯黄感冒片
C. 治感佳胶囊
D. 复方感冒灵颗粒
E. 感特灵胶囊

正确答案：A、B、C、D、E。维C银翘片；贯黄感冒片；治感佳胶囊；复方感冒灵颗粒；感特灵胶囊

解析：本题考查的是含西药组分的中成药。含有扑热息痛和（或）扑尔敏化学药物的中成药有维C银翘片（A对）、贯黄感冒片（B对）、治感佳胶囊（C对）、复方感冒灵颗粒（D对）与感特灵胶囊（E对）。扑热息痛即对乙酰氨基酚，是乙酰苯胺类解热镇痛药，可用于感冒或其他原因引起的高热和缓解轻中度疼痛，一般剂量较少引起不良反应。扑尔敏即氯苯那敏，常用其马来酸盐用于各种过敏性疾病，并与解热镇痛药配伍用于感冒，但有嗜睡、疲劳乏力等不良反应。维C银翘片：功能疏风解表，清热解毒。用于外感风热所致流行性感冒，症见发热、头痛、咳嗽、口干、咽喉疼痛。含西药成分：对乙酰氨基酚、马来酸氯苯那敏、维生素C。贯黄感冒片：功能辛凉解表，宣肺止咳。用于风热感冒，发热恶风，头痛鼻塞，咳嗽痰多。含西药成分：马来酸氯苯那敏。治感佳胶囊：功能清热解毒，疏风解表，用于温病初起，风热感冒，症见发热恶风、头痛鼻塞、咽喉肿痛、咳嗽痰黄。含西药成分：对乙酰氨基酚、盐酸吗啉双胍马来酸氯苯那敏。复方感冒灵颗粒：功能辛凉解表，清热解毒。用于风热感冒及温病之发热、微恶风寒、头身痛、口干渴、鼻塞涕浊、咽喉红肿疼痛、咳嗽、痰黄黏稠。含西药成分：对乙酰氨基酚、马来酸氯苯那敏、咖啡因。感特灵胶囊：功能清热解毒，清肺止咳。用于感冒初期引起的咳嗽，流清涕、头痛目眩。含西药成分：对乙酰氨基酚、马来酸氯苯那敏、咖啡因。